患者，男，65岁，患有骨质疏松症。根据该患者饮食习惯，每日需补充元素钙600mg。药师为其推荐碳酸钙（0.5g/片），该患者适宜的用法用量是
A. 1片tid
B. 2片tid
C. 4片qd
D. 6片qd
E. 8片tid

正确答案：A。1片tid

解析：本题考查计算。碳酸钙的分子量为100，其中钙占40%。0.5g碳酸钙含钙量为0.2g=200mg。该患者每日需补充钙600mg，因此推荐每次1片，每天三次服用（A对）。